利尿药初期降压机制可能是
A. 降低血管对缩血管剂的反应性
B. 增加血管对扩血管剂的反应性
C. 降低动脉壁细胞的Na⁺含量
D. 排钠利尿，降低胞外液及血容量
E. 诱导动脉壁产生扩血管物质

正确答案：D。排钠利尿，降低胞外液及血容量